患者，男，68岁。半身不遂，口眼歪斜，语言謇涩，口角流涎，下肢痿废，小便频数，舌苔白，脉缓。治疗应首选
A. 大秦艽汤
B. 补中益气汤
C. 补阳还五汤
D. 牵正散
E. 地黄饮子

正确答案：C。补阳还五汤

解析：本题考查常见的病症的辩证、处方。题中患者半身不遂，口眼歪斜，语言謇涩，口角流涎，下肢痿废，小便频数，舌苔白，脉缓，证属中风之气虚血瘀证。大秦艽汤，中医方剂名。为治风剂，具有疏风清热，养血活血之功效。主治风邪初中经络证。口眼斜，舌强不能言语，手足不能运动，或恶寒发热，苔白或黄，脉浮数或弦细（A错）。补中益气汤为补益剂，具有补中益气，升阳举陷之功效。主治脾虚气陷证。饮食减少，体倦肢软，少气懒言，面色萎黄，大便稀溏，舌淡，脉虚；以及脱肛、子宫脱垂、久泻久痢，崩漏等（B错）。补阳还五汤，中医方剂名。为理血剂，具有补气，活血，通络之功效。主治中风之气虚血瘀证。半身不遂，口眼㖞斜，语言謇涩，口角流涎，小便频数或遗尿失禁，舌暗淡，苔白，脉缓无力（C对）。牵正散为治风剂，具有祛风化痰，通络止痉之功效。主治风中头面经络。口眼喁斜，或面肌抽动，舌淡红，苔白（D错）。地黄饮子，中医方剂名，别名地黄饮。为补益剂，具有滋肾阴，补肾阳，开窍化痰之功效。主治下元虚衰，痰浊上泛之喑痱证。舌强不能言，足废不能用，口干不欲饮，足冷面赤，脉沉细弱（E错）。